关于接触式桥体的描述错误的是
A. 与牙槽嵴黏膜接触
B. 便于恢复缺失牙颈部边缘外形
C. 有利于恢复发音
D. 对牙槽嵴黏膜有生理性按摩作用
E. 可加速牙槽骨的吸收

正确答案：E。可加速牙槽骨的吸收

解析：本题考查固定桥的设计。接触式桥体：桥体的龈端与牙槽嵴黏膜接触（A对），便于恢复缺失牙颈部边缘外形（B对），也有利于恢复发音功能（C对），为临床常采用的一种桥体形式。当固定桥行使咀嚼功能时，桥体随基牙的生理性动度对牙槽嵴黏膜起到按摩作用（D对），有利于黏膜组织健康。部分（牙合）力经桥体龈端传递于牙槽嵴，减缓牙槽嵴吸收（E错，为本题正确答案）。